下列各项，对急性重型肝炎诊断无提示意义的是
A. 丙氨酸氨基转氨酶>1000U/L
B. 肝性脑病
C. 深度黄疸
D. 肝脏迅速缩小
E. 腹水肠胀气

正确答案：A。丙氨酸氨基转氨酶>1000U/L

解析：急性重症肝炎临床表现为黄疸迅速加深（C对）、明显的厌食，频繁的恶心、呕吐、腹水肠胀气（E对）、急剧乏力，少数病人病情进展迅速，黄疸不深，病人进入深昏迷，有肝性脑病（B对）的临床表现，起病十天之内出现肝性脑病的精神神经症状，如性格改变、睡眠节奏倒置、行为异常、计算能力减退，逐渐发展至定向力和理解能力丧失，最后嗜睡加深，浅昏迷时对各种刺激尚有反应，进入深昏迷时各种反应消失，少数病人可以出现抽搐。其诊断标准是急性黄疸型肝炎起病10天内迅速出现神经精神症状，同时有肝浊音界缩小（D对），黄疸急剧加深，胆红素大于正常值上限的10倍，凝血酶原活动度小于40%，而排除其他原因者，通过病毒指标以及肝脏病理可以确诊（A错，为本题正确答案）。